女性，28岁，乏力，面色苍白一年，近二周常有鼻出血。查：淋巴结未触及，肝脾不大。血红蛋白50g/L，白细胞3×10⁹/L，未见原始细胞，血小板21×10⁹/L，骨髓中巨核细胞明显减少。首选治疗
A. 输新鲜血
B. DA方案
C. 雄性激素
D. 糖皮质激素
E. 维生素B₁₂

正确答案：C。雄性激素